发生在指甲两旁的疔疮，称为
A. 沿爪疔
B. 蛇头疔
C. 蛇眼疔
D. 蛇背疔
E. 蛇腹疔

正确答案：C。蛇眼疔

解析：疔毒发生于指甲两旁，形如蛇眼者，称“蛇眼疔”（C对）。沿爪疔是手指疔肿之一，证见手指甲之一侧边缘出现轻微红肿、疼痛，或可延及对侧，甚则侵入指甲下，或化脓成疡者（A错）。脓性指头炎是手指末节掌面皮下组织的化脓性感染，中医称为"蛇头疔"（B错）。蛇背疔指疔疮生于手指甲根后者（D错）。手掌侧化脓性腱鞘炎及滑囊炎，中医学称之为“蛇肚疗”、“蛇腹疔”（E错）。